胃大部分切除术后患者出现贫血，其主要原因是
A. HCl减少
B. 黏液减少
C. 内因子减少
D. HCO₃⁻减少
E. 胃蛋白酶活性减弱

正确答案：C。内因子减少

解析：胃大部切除术切除了含有大量壁细胞的远端胃体，而壁细胞主要分泌盐酸（HCl）和内因子，HCl有助于铁的吸收，内因子是回肠吸收维生素B₁₂所必需的因子。因此胃大部切除术后出现贫血的主要原因是HCl、内因子减少（AC对）。本题AC均对，原答案为C。黏液减少（B错）、HC03-减少（D错）、胃蛋白酶活性减弱（E错）与术后出现贫血的关系不大。